能缓和拘急疼痛的药物大多具有的药味是
A. 苦味
B. 咸味
C. 辛味
D. 甘味
E. 酸味

正确答案：D。甘味

解析：苦味能泄、能燥、能坚，具有清泄火热、泄降气逆、通泄大便、燥湿、坚阴等作用（A错）。咸味能下、能软，具有泻下通便、软坚散结的作用（B错）。辛味能散、能行，具有发散、行气行血的作用（C错）。甘味能补、能和、能缓，具有补益、和中、调和药性和和缓急止痛的作用（D对）。酸味能收、能涩，具有收敛、固涩的作用（E错）。